市场营销专家劳特朋提出了“从4P走向4C”的口号，下列不属于4C的是
A. 顾客
B. 生产者
C. 成本
D. 购买的便利性
E. 沟通

正确答案：B。生产者